有完整细胞核的微生物是
A. 立克次体
B. 放线菌
C. 细菌
D. 真菌
E. 衣原体

正确答案：D。真菌